以下关于腮腺良性肿瘤的诊断与治疗哪项是错误的
A. 可采用“细针吸取活检”作穿刺细胞学检查
B. 术前行活组织检查以明确诊断
C. 术中可行冰冻活组织检查以明确肿瘤性质
D. 术中应保证面神经不受损伤
E. 禁忌作简单的、顺包膜剥离的剜出术

正确答案：B。术前行活组织检查以明确诊断

解析：本题考查腮腺良性肿瘤的诊断与治疗。对于腮腺部位的肿瘤，大多为混合瘤，因其易发生恶变，应采取有效的手段来诊断，并取得最佳的治疗效果。腮腺肿瘤禁忌活检（B错，为本题的正确答案），以免造成肿瘤种植扩散，成为长久不愈的腮腺瘘。腮腺良性肿瘤可采用细针穿刺活检（A对），涂片作细胞学检查，起到定性诊断。对已决定手术治疗的病变，可行冰冻活组织检查可明确肿瘤性质（C对），从而决定切除范围。因面神经与腮腺肿瘤关系密切，若不熟悉此部位的解剖关系则可损伤面神经造成面瘫，术后可出现口眼歪斜，给患者带来痛苦，故在术中应保证面神经不收损伤（D对）。腮腺肿瘤包膜多不完整，切破肿瘤可发生种植，采用单纯沿包膜剥离的方法（E对），常有复发，故应从薄膜外正常组织进行，同时切除部分或整个腺体，以防止复发。